下列说法中哪项是正确的
A. 任何疾病发生到—定阶段后终将结束，这就是疾病的转归
B. 任何疾病都存在转归问题
C. 死亡不是疾病的转归形式
D. 转归取决于机体损伤与抗损伤反应的力量对比
E. 通常所说的转归就是转归期

正确答案：D。转归取决于机体损伤与抗损伤反应的力量对比

解析：疾病的转归主要有康复和死亡两种（AC错）。疾病的转归取决于病因的类型及损伤程度、机体抗损伤反应的能力以及合理及时的治疗方案等因素（B错D对）。疾病有一个发生发展的过程，大多数疾病发生发展到一定阶段后终将结束，这就是疾病的转归，转归期是疾病的最后阶段（E错）。